干姜的主治病证是
A. 虚寒呃逆
B. 阳虚外感
C. 寒郁肝脉
D. 气血亏虚
E. 寒饮咳喘

正确答案：E。寒饮咳喘

解析：本题考查干姜的主治病证。干姜的主治病证是寒饮咳喘（E对）。干姜【主治病证】（1）脾胃受寒或虚寒所致的腹痛、呕吐、泄泻。（2）亡阳欲脱。（3）寒饮咳喘。丁香【主治病证】（1）中寒呃逆（A错）、呕吐、泄泻，脘腹冷痛。（2）肾阳虚之阳痿、宫冷。附子【主治病证】（1）亡阳欲脱。（2）肾阳不足、命门火衰之畏寒肢冷、阳痿、宫冷、尿频。（3）脾肾阳虚之脘腹冷痛、泄泻、水肿。（4）心阳虚衰之心悸、胸痹。（5）寒湿痹痛，阳虚外感（B错）。荔枝核【性能特点】本品微苦泄散，甘温能通，入肝、胃经。能行气、散结、祛寒而止痛，善治寒滞肝脉（C错）及肝胃不和所致诸痛。紫河车【主治病证】（1）肾虚精亏之不孕、阳痿、遗精、腰酸。（2）气血两亏之面色萎黄、消瘦乏力、产后少乳。（3）肺肾两虚之气喘咳嗽。（4）癫痫久发，气血亏虚（D错）。